服用抗贫血药琥珀酸亚铁时
A. 忌饮酒
B. 宜多饮水
C. 忌喝茶
D. 禁吸烟
E. 宜多食脂肪餐

正确答案：C。忌喝茶

解析：本题考查服用药物的特殊提示。服用抗贫血药琥珀酸亚铁时忌喝茶（C对）。茶叶中含有大量鞣酸，鞣酸和亚铁离子结合生成沉淀，影响药效。饮酒（A错），饮水（B错），吸烟（D错）对服用琥珀酸亚铁无影响。大量食用脂肪性食物（E错）会抑制胃酸分泌，减少铁的吸收，所以服用琥珀酸亚铁时应少吃脂肪餐。